最不可能出现右心室肥大的疾病是
A. 房间隔缺损
B. 小型室间隔缺损
C. 肺动脉狭窄
D. 艾森曼格综合征
E. 法洛四联征

正确答案：B。小型室间隔缺损

解析：室间隔缺损时一部分左心室血液通过缺损进入右心室，症状和心脏改变与缺损大小密切相关，小型室间隔缺损（B错，为本题正确答案）分流少，可无症状，心脏亦无明显改变；中型室间隔缺损心脏轻到中度增大，左、右心室增大，以左心室增大为主；大型室间隔缺损心脏中度以上增大，呈二尖瓣型，左、右心室增大，以右心室增大为主。房间隔缺损（A对）时左心房一部分血液通过缺损进入右心房，使右心房、右心室血流量增加，引起右心房、右心室增大。肺动脉狭窄（C对）时右心室向肺动脉射血受阻，右心室壁代偿性增厚，轻度中狭窄时心脏大小正常，重度狭窄时心脏增大，主要为右心室和右心房增大。艾森曼格综合征（D对）是左向右分流型先天性心脏病如房间隔缺损、室间隔缺损、动脉导管未闭等，出现肺动脉高压，右心室收缩压超过左心室时，左向右分流逆转为双向分流或右向左分流，出现发绀，是左向右分流型先天性心脏病晚期表现，已有右心室肥大。法洛四联征（E对）由4种畸形组成，即右心室流出道梗阻、室间隔缺损、主动脉骑跨、右心室肥厚，右心室肥厚因右心室流出道梗阻所致。